患者，男，53岁。头晕头痛，目眩，面红目赤，烦躁，口苦，便秘，小便短赤，舌红苔黄，脉弦数。血压170/100mmHg（22.6/13.3kPa）。其治法是
A. 滋阴平肝
B. 泻肝清火
C. 滋阴补阳
D. 化痰胜湿
E. 镇肝息风

正确答案：B。泻肝清火

解析：肝阳上亢，上冒清空，故头晕头痛，目眩；阳升则面红目赤；肝旺则烦躁，口苦，便秘，小便短赤；舌红苔黄，脉弦数皆是肝阳上亢之侯，故其治法是泻肝清火（B对）。滋阴平肝（A错）治疗阴虚阳亢证。滋阴补阳（C错）治疗阴阳两虚证。化痰胜湿（D错）治疗痰湿内盛证。镇肝息风（E错）治疗肝风上扰证。